下列有关疾病监测的论述哪项是错误的
A. 主动监测的结果要比被动监测准确
B. 哨点监测的耗费要比常规报告高
C. 监测病例的诊断要比实际病例简便
D. 直接指标的获得要比间接指标困难
E. 静态人群资料的处理比动态人群简单

正确答案：B。哨点监测的耗费要比常规报告高

解析：本题考查疾病监测的相关内容。疾病监测是现代疾病预防控制工作中最基本和最重要的内容之一，是制定与完善疾病预防控制措施和策略的科学依据和基础。在疾病监测中，主动监测的结果要比被动监测准确（A对）。哨点监测的耗费要比常规报告低（B错，为本题正确答案）。监测病例的诊断要比实际病例简便（C对）。直接指标的获得要比间接指标困难（D对）。静态人群资料的处理比动态人群简单（E对）。